女，30岁。腹痛、腹泻伴里急后重3天。最初为稀便，2天后为黏液脓血便，偶见片状灰白色膜状物排出。此病变最可能的炎症类型是
A. 纤维素性炎
B. 变质性炎
C. 浆液性炎
D. 出血性炎
E. 化脓性炎

正确答案：A。纤维素性炎

解析：青年女性患者，腹痛、腹泻伴里急后重3天，且有黏液脓血便和片状灰白色膜状物排出，考虑诊断为细菌性痢疾。细菌性痢疾是由痢疾杆菌引起的假膜性炎，而假膜性炎是发生于黏膜的纤维素性炎（A对），片状灰白色膜状物正是由渗出的纤维素、中性粒细胞等形成的“假膜”。